关于法莫替丁性质和结构的说法，错误的是
A. 法莫替丁结构中含有胍基取代的噻唑环
B. 法莫替丁对CYP450酶影响较小
C. 法莫替丁与西咪替丁的分子中均有含硫的四原子链
D. 法莫替丁有较强的抗雄激素副作用
E. 法莫替丁的吸收受食物影响较小

正确答案：D。法莫替丁有较强的抗雄激素副作用

解析：本题考查法莫替丁。法莫替丁为组胺H₂受体阻断剂，口服生物利用度约50%，且不受食物影响（E对）；未发现抗雄激素作用（D错，为本题正确答案）；法莫替丁的结构中含有胍基取代的噻唑环（A对），中间含硫四原子链（C对）；法莫替丁与肝药酶的亲和力较小，不抑制肝药酶（B对）。